青春期自我意识中的主要矛盾不包括
A. 理想与现实
B. 学习与恋爱
C. 本我与超我
D. 独立与依赖
E. 交往与封闭

正确答案：C。本我与超我

解析：青少年主要的生理心理发展特征为独立性与依赖性的矛盾（D对）、理想与现实的矛盾（A对）、情绪容易波动、性意识与社会规范之间的矛盾。教材自我意识的概念并未详述，查相关资料得知，自我意识是对自己身心活动的觉察，即自己对自己的认识，包括认识自己的生理状况、心理特征、以及自己与他人的关系。学习与恋爱（B对）、交往与封闭（E对）均是青春期自我意识的主要矛盾。本我与超我贯穿于人的多个时期，并不是青春期自我意识的主要矛盾（C错，为本题正确答案）。